患者，女性，48岁，月经或前或后，烘热出汗，五心烦热，头晕耳鸣，腰酸乏力，舌红苔薄，脉细数。治疗应首选
A. 两地汤合二至丸
B. 二仙汤合二至丸
C. 左归丸合二至丸
D. 内补丸
E. 肾气丸

正确答案：C。左归丸合二至丸

解析：患者，女，48岁，且主症为月经或前或后，故应考虑为绝经期前后，伴随症状为烘热出汗，五心烦热，头晕耳鸣，腰酸乏力，舌红苔薄，脉细数等阴虚证状，诊断为绝经期前后肾阴虚证，选方左归丸合二至丸（C对）。两地汤滋阴清热，治疗阴虚血热的月经先期（A错）。二仙汤温肾阳，补肾精，泻肾火，调冲任，二仙汤合二至丸治疗绝经期前后肾阴阳俱虚证（B错）。内补丸主治肾脏虚风，元气衰惫，膀胱冷痹，腰胯注痛，脚膝无力（D错）。肾气丸主治肾阳不足证（E错）。